环磷酰胺的抗癌作用机制
A. 影响蛋白质的合成和功能
B. 直接破坏DNA结构
C. 干扰核酸生物合成
D. 干扰生物碱合成
E. 影响体内激素平衡

正确答案：B。直接破坏DNA结构

解析：本题考查环磷酰胺的作用机制。环磷酰胺的抗癌作用机制是直接破坏DNA结构（B对）。环磷酰胺为周期非特异性药物。在体外无活性，在体内经肝细胞色素P450氧化、裂环生成中间产物醛磷酰胺，在肿瘤细胞内，分解出磷酰胺氮芥而发挥烷化作用，明显使S期的DNA发生烷化，形成交叉联结，抑制肿瘤细胞的生长繁殖。影响蛋白质的合成和功能（A错）的抗肿瘤药有紫杉醇、多西他赛、长春碱等。干扰核酸生物合成（C错）的抗肿瘤药有甲氨蝶呤、氟尿嘧啶、巯嘌呤、阿糖胞苷、羟基脲等。干扰生物碱合成（D错）不能达到抗癌作用。影响体内激素平衡（E错）的抗肿瘤药有肾上腺皮质激素、雌激素、雄激素及其拮抗剂，如他莫昔芬、甲地孕酮等。